常规X线根尖片可检查的内容不包括
A. 牙根数目
B. 牙根形态
C. 牙根长度
D. 颞下颌关节病变情况
E. 牙周组织健康状态

正确答案：D。颞下颌关节病变情况

解析：常规X线根尖片能够确定牙根及牙周支持组织的健康状况，了解牙根的数目、形态及长度，有无根折、根管充填等情况。另外，根尖片常常能够检查出牙邻面、牙颈部、牙根部等临床上较为隐蔽部位的龋坏。掌握“修复学临床检查”知识点。